急性期反应蛋白中具有清除异物和坏死组织作用的蛋白是
A. 纤维蛋白原
B. C-反应蛋白
C. 铜蓝蛋白
D. 结合珠蛋白
E. α1-蛋白酶抑制剂

正确答案：B。C-反应蛋白

解析：C-反应蛋白（B对）即CRP是急性期反应蛋白中具有清除异物和坏死组织作用的蛋白。